机体内起抗邪愈病作用的物质总称为
A. 正气
B. 邪气
C. 谷气
D. 元气
E. 四气

正确答案：A。正气

解析：本题考查的是正气的概念。机体内起抗邪愈病作用的物质总称为正气（A对）。正气，是指存在于人体、具有抗邪愈病作用的各种物质与功能的总称。邪气（B错），是指存在于外在环境中，或人体内部产生的具有致病作用的各种因素的总称。谷气（C错），即水谷精气，来源于饮食物，通过脾胃运化功能而生成。元气（D错）：又称“原气”，是人体最基本、最重要的气，是人体生命活动的原动力。四气（E错），指中药的寒、热、温、凉四种性质和作用。